精神症状主要通过以下哪些检查确定
A. 陪同就诊人员的叙述
B. 体格检查
C. 面谈及观察
D. 实验室检查
E. 智力测验

正确答案：C。面谈及观察